先天禀赋决定体质的相对
A. 可变性
B. 连续性
C. 复杂性
D. 普遍性
E. 稳定性

正确答案：E。稳定性

解析：体质具有个体差异性、形神一体性、群类趋同性（普遍性）、相对稳定性、动态可变性（可变性）、连续可测性（连续性）、后天可调性。先天禀赋决定着个体体质的相对稳定性（E对）。 个体差异性：由于个体的先天禀赋和后天因素不同，所形成的体质特征因人而异，有显著的个体差异，是体质学说研究的核心问题。 形神一体性：“形神合一”是中医学体质概念的基本特征之一，复杂多样的体质差异反映着人体在形态结构及脏腑活动所产生的各种精神活动的基本特征，是特定而生理特性与心理特性的综合，是对个体身心特性的概括。 群类趋同性（普遍性）：同一种族或聚居在同一地域的人，因为生存环境和生活习惯相同，遗传背景和生存环境具有同一性和一致性，从而使人群的体质具有相同或类似的特点，因此体质具有群类趋同性（D错）。 动态可变性（可变性）：后天因素使体质具有可变性（A错）。 连续可测性（连续性）：体质的连续性体现在不同个体体质的存在和演变在时间上的不间断性，体质特征伴随生命自始至终的全过程，具有循着某种类型体质固有的发展演变规律缓慢演化的趋势，这就使得体质具有可预测性，从而为治未病提供了可能（B错）。 后天可调性：体质的相对稳定与动态可变的特点为改善体质提供了前提。